一次性无菌注射器和一次性输液器属于
A. 第一类医疗器械产品
B. 第二类医疗器械产品
C. 第三类医疗器械产品
D. 第四类医疗器械产品
E. 第五类医疗器械产品

正确答案：C。第三类医疗器械产品

解析：本题考查的是医疗器械分类。一次性无菌注射器和一次性输液器属于第三类医疗器械产品（C对）。第一类（A错）是风险程度低，实行常规管理可以保证其安全、有效的医疗器械。第二类（B错）是具有中度风险，需要严格控制管理以保证其安全、有效的医疗器械。第三类是具有较高风险，需要采取特别措施严格控制管理以保证其安全、有效的医疗器械。